患者，女，55岁，患有垂体瘤，泌乳素水平高，餐后上腹饱胀，恶心2周，禁用的药物是
A. 艾司奥美拉唑
B. 铝碳酸镁
C. 法莫替丁
D. 复方消化酶
E. 多潘立酮

正确答案：E。多潘立酮

解析：本题考查药物的禁忌症。该患者患有垂体瘤，泌乳素水平高，禁用多潘立酮（E对）。多潘立酮为促胃肠动力的药物，有促进脑垂体泌乳素释放的作用，在胃肠道出血、机械性肠梗阻、胃肠穿孔、分泌催乳素的垂体肿瘤患者禁用。艾司奥美拉唑（A错）禁用于已知对艾司奥美拉唑，其他苯并咪唑类化合物过敏者。铝碳酸镁（B错）禁用于对本品过敏者。法莫替丁（C错）禁用于对本品过敏者、严重肾功能不全者。复方消化酶（D错）禁用于急性肝炎患者及胆道完全闭锁患者。